男，30岁。饥饿性上腹痛2年，进食后可缓解。胃镜检查：十二指肠溃疡愈合期，快速尿素酶试验阳性。最有效的治疗方案是
A. 奥美拉唑+枸橼酸铋钾+克拉霉素
B. 法莫替丁+阿莫西林+克拉霉素
C. 西咪替丁+克拉霉素+左氧氟沙星
D. 奥美拉唑+硫糖铝
E. 奥美拉唑+阿莫西林+替硝唑

正确答案：E。奥美拉唑+阿莫西林+替硝唑

解析：青年男性患者，饥饿性上腹痛，进食后可缓解（节律性上腹饥饿痛）。胃镜检查示十二指肠溃疡愈合期，考虑诊断为十二指肠溃疡。快速尿素酶试验阳性，提示患者伴有幽门螺杆菌感染。最有效的治疗方案是根除幽门螺杆菌治疗，如三联疗法（1种质子泵抑制剂+2种抗生素或1种铋剂+2种抗生素）或四联疗法（1种质子泵抑制剂+1种铋剂+2种抗生素），疗程7～14天。该题目选项中，奥美拉唑为质子泵抑制剂，枸橼酸铋钾为铋剂，克拉霉素、阿莫西林、左氧氟沙星、替硝唑为抗生素，法莫替丁、西咪替丁为H₂受体阻滞剂，硫糖铝为弱碱性抗酸剂，故奥美拉唑+阿莫西林+替硝唑为最有效的治疗方案（E对）。H₂受体阻滞剂抑酸率和溃疡愈合率低于质子泵抑制剂，故不用H₂受体拮抗剂替代质子泵抑制剂（BC错）。根除幽门螺杆菌治疗方案中至少含两种抗生素（AD错）。